适于餐中服用的药品是
A. 莫沙必利
B. 艾司唑仑
C. 帕罗西汀
D. 氢氯噻嗪
E. 阿卡波糖

正确答案：E。阿卡波糖

解析：本题考查药品服用的适宜时间。阿卡波糖（E对）为降糖药，适合餐中服用以减少对胃肠道的刺激和不良反应。莫沙必利（A错）为促胃动力药，餐前服用有助消化。艾司唑仑（B错）为催眠药，故适合睡前服用。帕罗西汀（C错）为抗抑郁药，应该清晨服用。氢氯噻嗪（D错）最新版考试指导未说明。